为了防止食品变质，最常用的方法是
A. 通风
B. 低温贮存
C. 改变食品的pH值
D. 降低食品的含水量
E. 食品紫外线照射

正确答案：B。低温贮存